下列有关胎盘屏障的叙述，错误的是
A. 是胎盘绒毛与子宫血窦问的屏障
B. 通透性与一般毛细血管相同
C. 几乎所有药物均可通过
D. 可阻止药物从母体进入胎儿的血液循环中
E. 妊娠妇女原则上应禁用一切影响胎儿发育的药物

正确答案：D。可阻止药物从母体进入胎儿的血液循环中

解析：胎盘屏障是指胎盘绒毛与子宫血窦间的屏障（A对），其能将母体与胎儿的血液分开。所有药物均能通过胎盘进入胎儿体内，仅是程度、快慢不同（BC对）。屏障能阻止水溶性或解离型药物进入胎儿体内，但脂溶性较高的药物仍能通过胎盘屏壁（D错，为本题正确答案）。由于有些通过胎盘的药物对胎儿有毒性甚至可以导致畸胎，因此孕妇用药应特别谨慎（E对）。